急性糜烂出血性胃炎的常见病因不包括
A. 非甾体抗炎药
B. 脑外伤
C. 乙醇
D. 幽门螺杆菌感染
E. 严重烧伤

正确答案：D。幽门螺杆菌感染

解析：急性胃炎常见病因有应激如脑外伤（B对）、严重烧伤（E对）；药物如非甾体类抗炎药物（A对）；酒精（C对）；创伤和物理因素；十二指肠-胃反流；胃黏膜血液循环障碍等。幽门螺杆菌感染（D错，为本题正确答案）是慢性胃炎最常见的病因，与急性糜烂出血性胃炎无关。